骨性关节炎治疗中，具有软骨保护作用的药物是
A. 双氯芬酸
B. 白芍总苷
C. 氨基葡萄糖
D. 曲安奈德
E. 阿达木单抗

正确答案：C。氨基葡萄糖

解析：本题考查骨性关节炎的药物治疗。改善病情类药物及软骨保护剂包括双醋瑞因、氨基葡萄糖（C对）等，此类药物在一定程度上可延缓病程、改善患者症状。